采用体穴针刺麻醉施行甲状腺手术，应首选
A. 合谷、内关
B. 太冲、金门
C. 三阴交、人中
D. 神门、交感
E. 支沟、公孙

正确答案：A。合谷、内关

解析：合谷、内关两穴的得气感都很强，用这两个穴位组成的处方可适用于全身不同部位的手术，对头面部、颈部和胸部手术的镇痛效果尤其满意（A对）。神门、交感（D错）是耳针麻醉选穴的基本穴，任何手术都可选用，但题中明确采用体穴针刺麻醉，故错误。